可引起横纹肌溶解症的药物是
A. 辛伐他汀
B. 普罗布考
C. 烟酸
D. 阿昔莫司
E. 考来烯胺

正确答案：A。辛伐他汀

解析：本题考查辛伐他汀。可引起横纹肌溶解症的药物是辛伐他汀（A对）。辛伐他汀为他汀类调血脂药，各种他汀类药物都可能引起肌肉无力、肌肉疼痛、肌酸激酶（CK）值升高或横纹肌溶解等肌病。普罗布考（B错）为抗氧化药，不良反应一般较轻微，以胃肠道反应为主，如恶心、呕吐、腹泻、腹痛等。部分患者有头痛、头晕、血管性神经水肿、血小板减少、肌病、感觉异常等。烟酸（C错）和阿昔莫司（D错）为烟酸类调血脂药，不良反应主要为潮红、心悸和胃肠道紊乱等，大剂量可引起肝功能失调、糖耐量异常，可使循环中尿酸增加而诱发痛风等，停药后可以恢复。考来烯胺（E错）为胆汁酸结合树脂，常见恶心、腹胀、便秘等。长期应用可引起脂溶性维生素缺乏，也可引起高氯血症酸中毒。